患者，女，45岁，身高160cm，体重75kg，临床诊断为Ⅱ型糖尿病。实验室检查：空腹血糖8.7mmol/L（正常值：3.9～6.1mmol/L），餐后2h血糖13.1mmol/L（正常值：<7.8mmol/L），糖化血红蛋白7.1%（正常值：4.8%～6.0%）。经饮食控制，规律锻炼，血糖控制仍未达到理想水平。该患者经治疗2周后，空腹血糖恢复正常，餐后血糖仍未达标，最适宜家用的降糖药物是
A. 磺酰脲类
B. 噻唑烷二酮类
C. 双胍类
D. 胰岛素
E. α-葡萄糖苷酶抑制剂

正确答案：E。α-葡萄糖苷酶抑制剂

解析：本题考查降糖药。α-葡萄糖苷酶抑制剂（E对）是单纯餐后血糖高，而空腹和餐前血糖不高的糖尿病的首选治疗药物。磺酰脲类（A错）用于2型非肥胖型糖尿病患者。噻唑烷二酮类（B错）用于餐前餐后血糖升高患者。二甲双胍（C错）是2型肥胖型糖尿病患者的首选用药。胰岛素（D错）用于1型糖尿病。